下列窝洞属于Black分类Ⅰ类洞的有
A. 磨牙的（牙合）面洞
B. 下磨牙颊面（牙合）2/3的颊面洞
C. 上前牙腭面洞
D. A和B
E. 以上都是

正确答案：E。以上都是

解析：本题考查Black分类法-Ⅰ类洞。Black分类Ⅰ类洞：所有牙面发育点隙裂沟的龋损所备成的窝洞，包括磨牙和前磨牙的（牙合）面洞（A对）、上颌前牙腭面洞、下颌磨牙颊面2/3的颊面洞和颊（牙合）面洞（BD对）、上颌磨牙腭面2/3的腭面洞和腭（牙合）面洞（C对），（ABCD均对，故E为本题的正确答案）。